轻型DIC患者可以使用
A. 肝素
B. 抗血小板药
C. 凝血因子
D. 抗纤溶药物
E. 胰岛素

正确答案：B。抗血小板药

解析：抗血小板药：适用于轻型DIC或者高度怀疑DIC而未肯定诊断或处于高凝状态的患者。掌握“弥散性血管内凝血（DIC）”知识点。